五脏疾病在儿科中，最常见的是
A. 心系疾病
B. 肝系疾病
C. 脾系疾病
D. 肺系疾病
E. 肾系疾病

正确答案：D。肺系疾病

解析：一般来说，儿科中最常见的五脏疾病是肺系疾病（D对）。脾系疾病（C错）位列第二。心系疾病（A错）、肝系疾病（B错）和肾系疾病（E错）紧随其后。